起效较慢，应告知患者使用后漱口的药物是
A. 异丙托溴铵气雾剂
B. 孟鲁司特钠咀嚼片
C. 茶碱片
D. 沙丁胺醇气雾剂
E. 布地奈德吸入剂

正确答案：E。布地奈德吸入剂

解析：本题考查支气管哮喘用药。起效较慢，应告知患者使用后漱口的药物是布地奈德（E对）。布地奈德是吸入性糖皮质激素，糖皮质激素在口咽局部的不良反应包括声音嘶哑、咽部不适和念珠菌感染。吸药后应及时用清水含漱口咽部，选用干粉吸入剂或加用储雾器可减少上述不良反应。异丙托溴铵气雾剂（A错）为抗胆碱药物。孟鲁司特钠咀嚼片（B错）为白三烯受体阻断剂。茶碱片（C错）为茶碱类药物。沙丁胺醇气雾剂（D错）为β₂受体激动剂。